女婴，2个月，拒食、吐奶、嗜睡3天。查体：面色青灰，前囟紧张，脐部少许脓性分泌物。为明确诊断，最关键的检查是
A. 脐分泌物培养
B. 头颅CT
C. 血常规
D. 血气分析
E. 脑脊液检查

正确答案：E。脑脊液检查

解析：本例患儿拒食、吐奶、嗜睡3天，面色青灰，前囟紧张，脐部少许脓性分泌物，说明有细菌感染并且累及脑部，为明确诊断，最关键的检查是脑脊液检查（E对）。脐分泌物培养（A错）常会培养出多种细菌，不能用于确诊本病致病菌。头颅CT（B错）多用于脑部外伤及脑部肿瘤诊断。血常规（C错）属于常规检查，并不能确诊本病。血气分析（D错）多用于肺部病变及酸碱中毒等疾病。